二期处理火器伤延期缝合应在清创处理后的
A. 12小时～1天
B. 2～4天
C. 3～5天
D. 6～14天
E. 14天以后

正确答案：C。3～5天

解析：火器伤组织损伤重、范围大、易感染，处理原则是彻底清创，延期缝合。处理时应尽早清创，充分暴露伤道，清除坏死和失活组织，清创后伤口一般不作一期缝合，因为初期清创时，挫伤区和震荡区参差交错，不易判断。此时应保持伤口引流通畅，3～5天（C对ABDE错）后酌情行二期缝合。